20（S）-原人参二醇在矿酸作用下易发生构型转化的位置是
A. C-8位
B. C-13位
C. C-10位
D. C-20位
E. C-14位

正确答案：D。C-20位

解析：本题考查的是构型转化。20（S）-原人参二醇在矿酸作用下易发生构型转化的位置是C-20位（D对）。A型皂苷元为20（S）-原人参二醇，B型则为20（S）-原人参三醇。这些皂苷的性质都不太稳定，用无机酸水解时C-20的构型易转化为R型，继之侧链受热发生环合，生成人参二醇和人参三醇。